食品卫生检查发现某个体户出售的猪肉有肉眼可见白色、绿豆大小半透明的水泡状包囊，包囊一端为乳白色。在40cm²的肌肉切面上检出包囊8个。此病畜肉的处理原则是
A. 冷冻处理
B. 盐腌处理
C. 高温处理
D. 销毁
E. 后熟产酸处理

正确答案：D。销毁